高热，既往胆囊切除史，39度，低血压，谵妄，黄疸，X线示胆总管及肝内外胆管扩张。目前治疗
A. 剖腹探查
B. 纠正水、电解质平衡
C. 穿刺引流
D. 胆管切开减压
E. 造瘘术

正确答案：D。胆管切开减压

解析：根据题干诊断考虑急性梗阻性化脓性胆管炎。治疗：原则是立即解除胆道梗阻并引流（胆总管切开减压、T管引流）（D对）。当胆管内压降低后，病人情况常能暂时改善，有利于争取时间继续进一步治疗。